患者，女性，42岁，舌苔部有一红色斑块一年余，病损时常变换位置，无自觉症状。患者的诊断可能是以下名称，除了
A. 地图舌
B. 游走性舌炎
C. 地图样舌炎
D. 剥脱性舌炎
E. 萎缩性舌炎

正确答案：E。萎缩性舌炎

解析：本题考查游走性舌炎的别称。患者，女性，42岁（中年女性），舌苔部有一红色斑块一年余（病损黏膜发红），病损时常变换位置（病变位置变化），无自觉症状，综合考虑诊断为游走性舌炎（B对）。患者的诊断不可能是萎缩性舌炎（E错，为本题正确答案）。萎缩性舌炎是指舌黏膜的萎缩性改变。黏膜表面的舌乳头萎缩消失，舌上皮全层以及舌肌都萎缩变薄，全舌色泽红，光滑如镜面，也可呈苍白，故又称为光滑舌或者镜面舌。游走性舌炎，又名地图舌（A对）或地图样舌（C对），是一种浅表性非感染性的舌部炎症，由于中央区表现为丝状乳头萎缩呈剥脱样，又叫做剥脱性舌炎（D对）。